根据微生物的分类，新生隐球菌属于
A. 细菌
B. 立克次氏体
C. 真菌
D. 放线菌
E. 支原体

正确答案：C。真菌

解析：新型隐球菌属于隐球菌属，是深部感染真菌（C对），具有完整的细胞核。